男性，29岁，腭前部肿胀1个月，X线检查见腭中线前部一圆形透射区。镜下见衬里上皮为复层鳞状上皮和假复层纤毛柱状上皮。最可能的病理诊断是
A. 鼻腭管囊肿
B. 鼻唇囊肿
C. 球状上颌囊肿
D. 根尖周囊肿
E. 牙源性角化囊肿

正确答案：A。鼻腭管囊肿

解析：鼻腭管囊肿可发生于任何年龄。男性较多见。临床上最常见的表现为腭中线前部的肿胀，有时可伴疼痛或瘘管形成。X线照片上，常常难以区分鼻腭管囊肿和较大的切牙窝。鼻腭管囊肿可内衬复层扁平上皮、含黏液细胞的假复层纤毛柱状上皮、立方上皮或柱状上皮，这些上皮类型可单独或联合存在。掌握“鼻腭管囊肿及鼻唇囊肿”知识点。